下列关于医院感染的特征的描述，哪项不正确
A. 病原体种类繁多
B. 病原体来源广泛
C. 医院中流行的菌株多为耐药菌株
D. 污染环节相对较少，容易控制
E. 易感人群中，抗病能力差，感染后病死率较高

正确答案：D。污染环节相对较少，容易控制